巨大脾脏常见于
A. 急性粒细胞白血病
B. 慢性粒细胞白血病
C. 急性淋巴细胞白血病
D. 慢性淋巴细胞白血病
E. 肝硬化脾功能亢进

正确答案：B。慢性粒细胞白血病

解析：巨大脾脏常见于慢性粒细胞性白血病（B对），往往就医时脾脏以达脐或脐以下，质地坚硬，平滑，无压痛。急性粒细胞性白血病（A错）（P580）、急性淋巴细胞白血病（C错）（P580）、慢性淋巴细胞白血病（P590）（D错）、肝硬化脾功能亢进（P421）（E错）时可见脾大，但多为轻至中度。